呼吸衰竭引起肺动脉高压的主要机制是
A. 血液粘滞性增高
B. 缺氧所致血量增多
C. 肺泡气氧分压降低引起肺血管收缩
D. 外周血管扩张血液回流增加
E. 肺小动脉壁增厚

正确答案：C。肺泡气氧分压降低引起肺血管收缩

解析：呼吸衰竭引起肺动脉高压的主要机制是肺泡气氧分压降低引起肺血管收缩（C对）。